关于甲状腺髓样癌，下列论述错误的是
A. 甲状腺髓样癌起源于甲状腺滤泡上皮
B. 髓样癌占甲状腺癌7％
C. 甲状腺髓样癌的肿瘤标记物是降钙素
D. 手术原则同乳头状腺癌
E. 可兼有淋巴和血行转移

正确答案：A。甲状腺髓样癌起源于甲状腺滤泡上皮

解析：甲状腺髓样癌起源于滤泡旁C细胞（A错，为本题正确答案），其他类型的甲状腺癌来源于甲状腺滤泡上皮细胞。髓样癌不常见，仅占甲状腺癌的7%（B对）。髓样癌来源于分泌降钙素的甲状腺滤泡旁细胞，血清降钙素升高可协助诊断甲状腺髓样癌，因此降钙素可作甲状腺髓样癌的肿瘤标记物（C对）。甲状腺髓样癌的手术原则同乳头状癌（D对），多主张甲状腺全切或近全切。甲状腺髓样癌可兼有淋巴结和血行转移（E对）。